急诊室因抢救患者未能及时书写病历的，在事故处理结束后，有关医务人员需要多少时间内补充病历
A. 12小时
B. 4小时
C. 2小时
D. 3小时
E. 6小时

正确答案：E。6小时

解析：《医疗事故处理条例》规定，因抢救急危患者，未能及时书写病历的，有关医务人员应当在抢救结束后6个小时内（E对）据实补记，并加以注明。